蒋某，女性，36岁，口腔多处溃疡1周，疼痛不能进食。检查：双颊、舌黏膜可见小米粒的溃疡十余个，散在分布，周围黏膜充血发红。患者以往曾有多次类似发作病史。该患者应诊断为
A. 白塞病
B. 带状疱疹
C. 疱疹样口疮
D. 疱疹性咽峡炎
E. 疱疹性龈口炎

正确答案：C。疱疹样口疮

解析：本题考查复发性阿氟他溃疡的临床表现。患者为中年女性，口腔多处溃疡，溃疡直径小，数目多，散在分布，周围黏膜充血发红，且有复发史，根据患者发病情况与临床特征可诊断为疱疹样口疮（疱疹型复发性阿弗他溃疡）（C对）。白塞病（A错）口腔溃疡的症状和发作规律与复发性阿弗他溃疡类似，但其主要临床特征是同时或先后发生的口腔黏膜溃疡以及眼、生殖器、皮肤病损，全身各器官均可受累。带状疱疹（B错）的水疱较大，疱疹聚集成簇，沿三叉神经的分支排列成带状，但不超过中线，疼痛剧烈。疱疹性咽峡炎（D错）病损的分布只限于口腔后部，如软腭、腭垂、扁桃体处，为丛集成簇的小水疱，不久溃破成溃疡，损害很少发生于口腔前部，牙龈不受损害，病程大约7天。疱疹性龈口炎（E错）好发于婴幼儿，全身反应重，病损表现为成簇的小水疱，疱破后成为大片表浅溃疡，损害遍及口腔黏膜各处，同时可伴有皮肤损害。